男，68岁。阵发性腹痛1年，自觉有“气块”在腹中窜动，起初大便次数增加，近3个月腹胀、便秘，近3天无肛门排气、排便，呕吐物有粪便臭味，一直感乏力和低热。禁忌使用的检查是
A. 结肠镜
B. 立位腹部X线平片
C. 腹部B超
D. 腹部CT
E. 全消化道钡餐造影

正确答案：E。全消化道钡餐造影

解析：患者腹痛、腹泻、肛门停止排气、排便，呕吐物有粪便臭味（低位肠梗阻典型表现），根据患者表现、病史，应诊断为肠梗阻。肠梗阻病人严禁使用全消化道钡餐造影，否则可能造成钡剂堵塞肠管，加重病情（E错，为本题正确答案）。考虑患者老年男性，有腹痛、排便次数增加、肠梗阻等表现，不排除结肠癌可能，可行结肠镜（A对）检查，于病变处取活检，进一步明确诊断。腹部X线平片（B对）、腹部B超（C对）、腹部CT（D对）禁忌极少，可作为辅助诊断措施。